在霉菌与害虫繁殖生长的旺季，对饮片的养护宜采用
A. 通风养护法
B. 密封养护法
C. 高温养护法
D. 清洁养护法
E. 对抗贮存法

正确答案：B。密封养护法

解析：本题考查的是中药传统养护技术。在霉菌与害虫繁殖生长的旺季，对饮片的养护宜采用密封养护法（B对）。密封（密闭）养护法：采用密封或密闭养护的目的是使饮片及其炮制品与外界的温度、湿度、空气、光线、细菌、害虫等隔离，尽量减少这些因素对药物的影响，保持饮片的原有质量，以防虫蛀、霉变。但在密封前饮片的水分不应超过安全值，且无变质现象，否则反而会有利于霉变虫蛀的发生。一般可分为容器密封、罩帐密封和库房密封三类。细料、贵重中药或饮片，除可用容器密封贮存外，还可采用复合薄膜材料包装袋真空密封贮存。对于当归、熟地、龙眼肉、党参以及蜜炙品等含糖量较多的药材，可采用薄膜材料密封贮存。此外，当气温逐渐升高，空气中相对湿度增大或当各种霉菌、害虫繁殖生长旺季时，则宜采用密封法或密闭法。通风养护法（A错）：利用自然气候来调节库房的温湿度，起到降温防潮作用。合理通风，可使干燥的药物不致受潮。一般应在晴天无雾及室外相对湿度低时开窗开门通风，反之则关窗关门，有条件的应在仓库内安装排风扇或其他通风设备。何时通风应酌情而定，如不考虑库内外温湿度情况，盲目通风则反而会使药物返潮，甚至带来不良后果。高温养护法（C错）：中药蛀虫对高温的抵抗力均很差，因此采用高温（如暴晒或烘烤）贮存中药饮片，可有效地防止虫害的侵袭。一般情况下温度高于40℃，蛀虫就停止发育、繁殖，当温度高于50℃时，蛀虫将在短时间内死亡。但必须注意的是，含挥发油的饮片烘烤时温度不宜超过60℃，以免影响饮片的质量。清洁养护法（D错）：搞好中药与仓库的清洁卫生是一切防治工作的基础。由于搞好清洁卫生可以恶化蛀虫的生活条件，杜绝蛀虫滋生，因此清洁卫生是防止仓虫入侵的最基本和最有效的方法。对抗贮存法（E错）：也称异性对抗驱虫养护，是采用两种或两种以上药物同贮，相互克制，起到防止虫蛀、霉变作用的养护方法。一般适用于数量不多的药物，如牡丹皮与泽泻、山药同贮，蛤蚧与花椒、吴茱萸或荜澄茄同贮，蕲蛇或白花蛇与花椒或大蒜瓣同贮，土鳖虫与大蒜同贮，人参与细辛同贮，冰片与灯心草同贮，硼砂与绿豆同贮，藏红花与冬虫夏草同贮等。还可采用与具有特殊气味的物质密封同贮，如山苍子油、花椒、樟脑、大蒜、白酒等，有时也可达到良好的防蛀、防霉效果。动物、昆虫类饮片，如乌梢蛇、地龙、蛤蚧等；油脂类中药及炮制品，如柏子仁、桃仁、枣仁等；含糖类饮片，如枸杞子、龙眼肉、黄芪、大枣等；贵重饮片，如冬虫夏草、鹿茸等；含挥发油类饮片，如当归、川芎、瓜蒌等；均可喷洒少量95%药用乙醇或50度左右的白酒密封养护，也可达到良好防蛀、防霉效果。